排列于腮腺浅叶前缘的解剖结构不包括
A. 面横动脉
B. 腮腺管
C. 面神经颞支
D. 面神经颧支
E. 面神经下颊支

正确答案：C。面神经颞支

解析：腮腺与神经血管关系密切，其中，穿经腮腺的主要神经血管由浅入深为面神经、下颌后静脉及颈外动脉等，根据腮腺内血管神经的走向，可将其分为纵行和横行两组，纵行组为颞浅动静脉、耳颞神经、下颌后静脉及颈外动脉，横行组为面神经、上颌动静脉及面横动脉；腮腺浅叶上缘神经血管排列从后向前依次为：颞浅静脉、耳颞神经、颞浅动脉、面神经颞支及颧支；腮腺浅叶前缘神经血管排列从上向下依次为：面横动脉、面神经颧支、面神经上颊支、腮腺管、面神经下颊支及下颌缘支；腮腺浅叶下端神经血管排列从前向后依次为：面神经下颌缘支、面神经颈支、下颌后静脉。腮腺深叶的神经血管为：颈内动脉、第Ⅸ～Ⅻ对脑神经。掌握“腮腺咬肌区、腮腺与面神经解剖关系”知识点。